颧牙槽嵴为
A. 颧骨伸向上颌第一磨牙的骨嵴
B. 颧突伸向上颌第一磨牙的骨嵴
C. 颧骨伸向上颌第二磨牙的骨嵴
D. 颧突伸向上颌第二磨牙的骨嵴
E. 颧骨伸向上颌尖牙的骨嵴

正确答案：B。颧突伸向上颌第一磨牙的骨嵴

解析：本题考查颧牙槽嵴。颧牙槽嵴为颧突伸向上颌第一磨牙（B对D错）的骨嵴。颧牙槽嵴在面部或口腔前庭均可触及，对上颌第二磨牙已缺失的患者，以颧牙槽嵴部的前庭沟为进针点，行上牙槽后神经阻滞麻醉。颧牙槽嵴是上颌骨的结构，不是颧骨（ACE错）的骨嵴。